转导是以下列哪项为媒介，将供体菌的基因转移到受体菌内
A. 噬菌体
B. 鞭毛
C. 菌毛
D. 螺旋体
E. 质粒

正确答案：A。噬菌体